治疗痰痫的首选方剂是
A. 温胆汤
B. 涤痰汤
C. 指迷茯苓丸
D. 定痫丸
E. 黄连温胆汤

正确答案：B。涤痰汤

解析：本证为痰气逆乱，扰腑阻络所致。临床以发作时抽搐症状较轻，而神识被蒙症状明显，或仅见头痛、腹痛、肢体麻木疼痛症状为特征。若见精神狂躁者多为痰郁化火，痰火上扰所致，宜用具有涤痰开窍功效的涤痰汤（B对）；温胆汤具有理气化痰，和胃利胆之功效，主治胆郁痰扰证，症见胆怯易惊，头眩心悸，心烦不眠，夜多异梦；或呕恶呃逆，眩晕，癫痫。苔白腻，脉弦滑（A错）；指迷茯苓丸具有燥湿和中、化痰通络的功效，用于治疗痰饮停滞中脘所致的疼痛。缓解两臂酸痛或抽掣，不能上举，疼痛左右转移，两手发麻，四肢浮肿等症状（C错）；定痫丸具有息风定痫的功效，用于治疗风痫，症见发作时突然仆倒，神志丧失，继而抽搐，颈项及全身强直，两目窜视，牙关紧闭，口吐白沫，口唇及面部色青，舌苔白，脉弦滑（D错）；黄连温胆汤具有泄火涤痰，清心安神的功效，用于治疗抽动障碍中的痰火扰心证，症见头面、躯干、四肢肌肉抽动，频繁有力，喉中痰鸣，怪声不断，或口出异声秽语，烦躁口渴，睡眠不安，便秘溲赤，舌质红，苔黄腻，脉滑数（E错）。